左归丸与一贯煎相同的功用是
A. 滋阴
B. 疏肝
C. 补脾
D. 降火
E. 益气

正确答案：A。滋阴

解析：本题考查左归丸与一贯煎的功效，属记忆内容。左归丸功用滋阴补肾，填精益髓。一贯煎功用滋阴疏肝。从书中可以明确得出两者功效相同点为滋阴（A对）。